三类中药新药批准文号的格式为
A. 国药准字AF××××××××
B. 国药准字S××××××××
C. 国药准字Z××××××××
D. 国药准字×××××××××
E. 国药试字Z××××××××

正确答案：C。国药准字Z××××××××

解析：本题考查药品批准文号的格式。三类中药新药批准文号的格式为国药准字Z××××××××（C对）。药品批准文号的格式为：国药准字H（Z、S、J）+4位年号+4位顺序号，其中H代表化学药品，Z代表中药，S代表生物制品，J代表进口药品分包装。